以下哪项不是流行病学的用途
A. 探索病因
B. 预防措施的效果评价
C. 临床观察
D. 人群患病情况分析
E. 评价治疗措施的效果

正确答案：C。临床观察